氟牙症发生于乳牙列的情况很少，除了胎盘的屏障作用，氟还在母体的哪种器官摄取
A. 骨骼
B. 肝
C. 肾
D. 脾
E. 肺

正确答案：A。骨骼

解析：氟牙症主要见于恒牙列，发生于乳牙的病变很少，这是由于过量的氟被母亲的骨骼摄取以及胎盘的屏障作用。掌握“氟牙症、先天性梅毒牙与牙本质形成缺陷”知识点。